蛋白质的RNI是指人群的
A. 必需氨基酸的平均需要量
B. 合成机体所需总氮量
C. 平均蛋白质最低生理需要量
D. 平均最低生理需要量加2个标准差
E. 平均蛋白质摄入量

正确答案：D。平均最低生理需要量加2个标准差